根据《专利法》关于药品专利期及专利权期限补偿制度的说法，错误的是
A. 药品包装外观设计专利的期限为10年
B. 新药发明专利权补偿期限不超过5年
C. 新药批准上市后总有效专利期限不超过14年
D. 药品发明专利权期限为20年

正确答案：A。药品包装外观设计专利的期限为10年

解析：本题考查药品专利期补偿制度。《专利法》第四十二条规定，发明专利权的期限为二十年（D对），实用新型专利权的期限为十年，外观设计专利权的期限为十五年（A错，为本题正确答案），均自申请日起计算。为补偿新药上市审评审批占用的时间，对在中国获得上市许可的新药相关发明专利，国务院专利行政部门应专利权人的请求给予专利权期限补偿。补偿期限不超过五年（B对），新药批准上市后总有效专利权期限不超过十四年（C对）。